医患之间信托关系的非陌生人关系特征，要求医师特别注意
A. 使用文明语言
B. 平等对待患者
C. 保守患者秘密
D. 遵守规章制度
E. 恪守医德职责

正确答案：E。恪守医德职责

解析：在市场经济条件下，个别单位、个别人员受市场经济消极因素的影响，把医患之间的这种诚信关系加以扭曲，看成单纯的商品供应者与消费者的经济关系或单纯的契约关系，片面追求自身的经济利益，导致医患之间关系紧张和不信任。这就要求了医师在处理医患关系当中应该特别注意恪守医生的医德医风，遵守医生的职责。掌握“医患关系伦理”知识点。